男，65岁。6个月前急性前壁心肌梗死，5个月来呼吸困难逐渐加重，稍活动即感气喘。查体：BP130/60mmHg，双肺底可闻及多量细湿啰音，可随体位变化，心率90次/分，心律齐。该患者的心功能分级是
A. NYHA分级Ⅲ级
B. Killip分级Ⅱ级
C. NYHA分级Ⅱ级
D. Killip分级Ⅲ级
E. 前临床心衰阶段

正确答案：A。NYHA分级Ⅲ级

解析：患者老年男性，6月前有既往心肌梗死病史，呼吸困难逐渐加重，稍活动即感气喘（慢性心力衰竭症状），查体：BP130/60mmHg（正常值90-120/60-90mmHg），双肺底可闻及多量细湿啰音，可随体位变化，考虑为慢性心力衰竭，适用于NYHA分级。病人稍活动即感气喘符合NYHAⅢ级（A对），即心脏病病人体力活动明显受限，低于平时一般活动即引起心衰症状。NYHAⅡ级（C错），即心脏病病人体力活动轻度受限，休息时无自觉症状，一般活动下可出现心衰症状。Killip分级适用于评价急性心肌梗死时心力衰竭的严重程度。I级：无心力衰竭的临床症状与体征。Ⅱ级（B错）：有心力衰竭的临床症状与体征。肺部50%以下肺野湿性啰音，心脏第三心音奔马律。Ⅲ级（D错）：严重的心力衰竭临床症状与体征。严重肺水肿，肺部50%以上肺野湿性啰音。Ⅳ级：心源性休克。本病患者并无急性心肌梗死，因此不能用Killip分级法。